按照《执业药师资格制度暂行规定》须提供参加继续教育的证明的是
A. 执业药师应履行的职责
B. 对执业药师继续教育的要求
C. 执业药师应遵守的基本准则
D. 执业药师注册的规定
E. 执业药师再注册的规定

正确答案：E。执业药师再注册的规定